治疗脱疽热毒证，应首选
A. 独活寄生汤
B. 桃红四物汤
C. 顾步汤
D. 人参养荣汤
E. 桂附八味丸

正确答案：C。顾步汤

解析：脱疽是指发于四肢末端，严重时趾（指）节坏疽脱落的一种慢性周围血管疾病，其临床特点是好发于四肢末端，以下肢为多见，初起患肢末端发凉、怕冷、苍白、麻木，可伴间歇性跛行，继则疼痛剧烈，日久患趾（指）坏死变黑，甚至趾（指）节脱落，热毒证，宜清热解毒止痛，用四妙勇安汤、顾步汤（C对）。独活寄生汤，功用温阳通脉、祛寒化湿，用于脱疽寒湿证（A错）。桃红四物汤，功用为活血调经，用于妇女月经不调，痛经，或由于瘀血所致的各种肿块（B错）。人参养荣汤，功用补益气血，宁心安神，用于疮疡溃后气血虚弱，久不收敛者（D错）。桂附八味丸，功用温补肾阳，用于命门火衰、脾肾阳虚证（E错）。